是一种物理性的防护技术，采用一次性的塑料纸覆盖经常接触，且难以清洁和消毒的部位，以减少工作区域表面的污染，此种方法称为
A. 地面消毒
B. 空气消毒
C. 器械消毒
D. 屏障防护技术
E. 敷料消毒

正确答案：D。屏障防护技术

解析：屏障防护技术是一种物理性的防护技术，采用一次性的塑料纸或透明的塑料套管覆盖治疗室那些经常接触，且难以清洁和消毒的部位，以减少工作区域表面的污染。掌握“患者、医务人员及环境的防护”知识点。